可防止胫骨移位的是
A. 前交叉韧带
B. 胫侧副韧带
C. 翼状褽
D. 半月板
E. 髌韧带

正确答案：A。前交叉韧带

解析：前后交叉韧带可以防止胫骨移位，前交叉韧带（A对）可防止胫骨前移，后交叉韧带可以防止胫骨后移。